在抗感冒药中，含有氯苯那敏成分复方制剂的应用目的是
A. 减轻鼻黏膜充血
B. 退热缓解疼痛
C. 对抗病毒复制
D. 改善体液循环
E. 减少打喷嚏或者鼻溢液

正确答案：E。减少打喷嚏或者鼻溢液

解析：本题考查抗感冒药复方制剂。在抗感冒药中，含有氯苯那敏成分复方制剂的应用目的是减少打喷嚏或者鼻溢液（E对）。感冒初始阶段，可出现卡他症状，如鼻腔黏膜血管充血、喷嚏、流泪、流涕、咽痛、声音嘶哑等症状，可选服含有盐酸伪麻黄碱或氯苯那敏的制剂，如美扑伪麻、酚麻美敏胶囊、双扑伪麻、氨酚伪麻、伪麻那敏、氨酚曲麻等制剂。减轻鼻黏膜充血（A错）的成分是伪麻黄碱。退热缓解疼痛（B错）的是解热镇痛药，如阿司匹林、对乙酰氨基酚。对抗病毒复制（C错）的成分是抗病毒药。改善体液循环（D错）的成分主要是蛋白水解酶。